可促进肌肉发达，运动员禁用多肽激素
A. 人促红素
B. 人生长激素
C. 精蛋白锌胰腺素
D. 利妥昔单抗
E. 促性腺激素

正确答案：A、B、E。人促红素；人生长激素；促性腺激素

解析：本题考查运动员禁用的药品。人促红素（A对）、人生长激素（B对）、促性腺激素（E对）都属于兴奋剂中的肽类激素，可促进肌肉发达，运动员禁用。精蛋白锌胰腺素（C错）用于治疗糖尿病。利妥昔单抗（D错）为抗肿瘤药物。